男，70岁。双手指间关节疼痛2年，每日晨僵数分钟。查体：T36.6℃，P70次／分，R18次／分，BP100/70mmHg，皮肤未见皮疹，心肺腹未见异常，双手远端指间关节Heberden结节，双手近端指间关节骨性膨大。血沉正常，ASO（-），RF（-）。可选择的一线治疗药物是
A. 秋水仙碱
B. 甲氨蝶呤
C. 柳氮磺吡啶
D. 双氯芬酸钠
E. 青霉素

正确答案：D。双氯芬酸钠

解析：患者老年男性，双手指间关节疼痛2年，每日晨僵数分钟（骨关节炎临床表现）。查体：双手远端指间关节Heberden结节，双手近端指间关节骨性膨大（骨关节炎典型体征）。实验室检查无明显异常。根据临床表现及实验室检查，该患者最可能的诊断是骨关节炎。该病治疗包括1.控制症状药物，即非甾体类抗炎药，如双氯芬酸钠（D对）、阿司匹林等；2.改善病情药物，如氨基葡萄糖、硫酸软骨素、双醋瑞因等，但目前尚未获得公认；3.软骨保护剂：关节内注射透明质酸。秋水仙碱（A错）是有丝分裂抑制剂，临床用于急性痛风和部分肿瘤，如乳腺癌、食管癌等的治疗。甲氨蝶呤（B错）为二氢叶酸还原酶抑制剂，临床用于肿瘤化疗和类风湿关节炎以缓解病情。柳氮磺吡啶（C错）在肠微生物作用下分解成5-氨基水杨酸发挥主要作用，临床用于类风湿关节炎和溃疡性结肠炎，控制疾病炎症发展。